选择饮用水水源时，除考虑水源充足、水质良好和便于防护外，还应考虑
A. 安全卫生
B. 技术经济上合理
C. 运行费用低廉
D. 兼顾城镇的中远期发展
E. 配水管网配置方便

正确答案：B。技术经济上合理

解析：本题考查饮用水水源选择的原则。选择饮用水水源时，应考虑的原则有：1.水量充足：水源的水量应能满足城镇或居民点的总用水量，并考虑近期和远期的发展；2.水质良好：水源水质应符合规定要求；3.便于防护：旨在保证水源水质不致因污染而恶化。有条件时宜优先选用地下水。采用地表水作水源时，应结合城市发展规划，将取水点设在城镇和工矿企业的上游，以防止水源污染；4.技术经济上合理（B对ACDE错）：选择水源时，在分析比较各个水源的水量和水质后，可进一步结合水源水质和取水、净化、输水等具体条件，考虑基本建设投资费用最小的方案。